患者，女性，64岁。因刺激性咳嗽4个月，血丝痰3个月，一直服中药效果欠佳，近1周出现右胸持续性隐痛，进行性加剧，咳痰渐多，伴发热，体温37.4～38.5°C，转呼吸科诊治，经检查证实为右肺鱗癌，胸膜转移，右侧恶性胸腔积液，右肺阻塞性肺炎。下列治疗方案应选择
A. 抽胸水后尽快手术治疗，术后放疗+化疗
B. 抽胸水后尽快手术治疗，术后仅做放疗
C. 抽胸水后尽快手术治疗，术后化疗3～6次
D. 胸水引流术治疗+化学性胸膜固定术治疗+肺癌化疗
E. 胸水引流术治疗+化学性胸膜固定术治疗+肺癌术前化疗+术后免疫辅助治疗

正确答案：D。胸水引流术治疗+化学性胸膜固定术治疗+肺癌化疗

解析：该患者肺癌合并胸膜转移，右侧恶性胸腔积液，属IV期，已经失去手术治疗机会，治疗方案中所有含手术的方案均为不合理的方案，故应该选D。掌握“肺癌”知识点。